原发性肝癌气滞血瘀证，首选
A. 一贯煎合猪苓汤
B. 中满分消丸
C. 犀角地黄汤
D. 茵陈蒿汤合膈下逐瘀汤
E. 逍遥散合桃红四物汤

正确答案：E。逍遥散合桃红四物汤

解析：原发性肝癌气滞血瘀证首选逍遥散合桃红四物汤，逍遥散治疗肝郁气滞，桃红四物汤活血化瘀，故首选一贯煎合猪苓汤（E对）治疗肝肾阴虚型肝硬化腹水（A错）。中满分消丸主治中满热胀，鼓胀，气胀，水胀（B错）。犀角地黄汤主治热入血分证，热伤血络，蓄血瘀热，。临床应用于治疗重症肝炎、肝昏迷、弥漫性血管内凝血、尿毒症、过敏性紫癜、急性白血病等血分热盛者（C错）。茵陈蒿汤合膈下逐瘀汤用于黄胆性肝炎、病毒性肝炎、血病、胃病、退烧、缓泻，并具有滋补作用（D错）。